G+细菌不具备的成分是
A. 肽聚糖
B. 脂多糖
C. 磷壁酸
D. N-乙酰胞壁酸
E. N-乙酰葡糖胺

正确答案：B。脂多糖

解析：革兰阳性细菌细胞壁特点：①肽聚糖含量丰富，层厚，20～80nm；②细胞壁中含有大量磷壁酸；③四肽侧链与五肽交联桥相连，形成三维立体结构。革兰阴性细菌细胞壁特点：①肽聚糖含量少，层薄，10～15nm；②细胞壁中不含磷壁酸；③缺少五肽交联桥，四肽侧链直接相链，形成二维网状结构；④肽聚糖层外包绕外膜层：脂质双层、脂蛋白、脂多糖；⑤脂多糖是革兰阴性细菌内毒素主要成分。掌握“细菌的大小、形态和基本结构”知识点。